同名手足阳经交接的部位是
A. 头面部
B. 肩项部
C. 四肢部
D. 颈项部
E. 肩胛部

正确答案：A。头面部

解析：头面为诸阳之会，所以手足阳经在头面交接（A对）。如手阳明大肠经与足阳明胃经交接于鼻翼旁；手太阳小肠经与足太阳膀胱经交接于目内眦；手少阳三焦经与足少阳胆经交接于目外眦。